自律性最高的是
A. 窦房结
B. 心房肌
C. 房室交界
D. 心室肌
E. 普肯耶纤维

正确答案：A。窦房结